食物中毒调查的目的是
A. 查清发病人数
B. 查清是否为食物中毒及中毒原因
C. 查清潜伏期的长短
D. 查清责任者并收集处罚依据
E. 以上都是

正确答案：E。以上都是